流行病学实验研究的人群来自
A. 同一总体的患某病的患者
B. 同一总体的健康人
C. 同一总体的暴露人群和非暴露人群
D. 同一总体的干预人群和非干预人群
E. 同一总体的病例人群和非病例人群

正确答案：D。同一总体的干预人群和非干预人群